支配小腿外侧群肌
A. 腓深神经
B. 胫神经
C. 腓肠神经
D. 股神经
E. 腓浅神经

正确答案：E。腓浅神经

解析：腓深神经（A错）分布于小腿前群肌、足背肌及第1、2趾相对缘的皮肤。胫神经（B错）分布于小腿后群诸肌。腓肠神经（C错）分布于足背及小趾外侧缘皮肤。股神经（D错）主要分布于髂肌、耻骨肌、股四头肌和缝匠肌。腓浅神经（E对）分布于小腿外侧、足背和第2-5趾背的皮肤。